地方性砷中毒的主要临床表现不包括
A. 躯干、四肢的皮肤色素沉着和脱色斑点
B. 手掌和脚趾皮肤过度角化
C. 多发性皮肤癌
D. 周围神经炎
E. 听力受损

正确答案：E。听力受损

解析：本题考查慢性砷中毒的临床表现。地方性砷中毒是由于长期自饮用水、室内煤烟、食物等环境介质中摄入过量的砷而引起的一种生物地球化学性疾病。临床上以末梢神经炎（D对）、皮肤色素代谢异常（A对）、掌跖部皮肤角化（B对）、肢端缺血坏疽、皮肤癌变（C对）为主要表现，是一种伴有多系统、多脏器受损的慢性全身性疾病。听力受损（E错，为本题正确答案）不是慢性砷中毒的临床表现。